男性，60岁，诊断为急性胆囊炎。经非手术治疗已5天，目前仍疼痛加剧，伴高热，右上腹广泛压痛，反跳痛，腹肌紧张，肠音减弱，体温39℃，白细胞计数18×10⁹/L，该患者最可能的并发症是
A. 胆囊积脓
B. 细菌性肝脓肿
C. 急性胰腺炎
D. 胆囊十二指肠内瘘
E. 胆囊坏疽穿孔

正确答案：E。胆囊坏疽穿孔

解析：治疗后疼痛加剧，说明效果不佳，右上腹广泛压痛，反跳痛，腹肌紧张，肠音减弱，提示有腹膜刺激征，怀疑有穿孔，坏死的可能，故选胆囊坏疽穿孔（E对）。胆囊积脓（A错）症状局限，不会出现腹膜刺激征。细菌性肝脓肿（C错）主要症状是发热肝区疼痛，不会有腹膜刺激征。急性胰腺炎（C错）腹痛加剧持续不缓解的情况下，会出现多器官衰竭的症状。胆囊十二指肠内瘘（D错）症状类似胆囊炎，不会出现腹膜刺激征。